患者，女，65岁。左下第一、二磨牙颊侧牙龈溃疡半年余，似菜花样，抗炎治疗无效。根据上述描述，为明确诊断该患者应进行的检查是
A. 拍摄X线牙片
B. CT
C. B超
D. 切取活检
E. 核磁共振成像

正确答案：D。切取活检

解析：患者牙龈部溃疡半年不愈，应警惕恶性肿瘤，为明确诊断，首选要采取切取活检的诊断方法。掌握“鳞状细胞癌概述及舌癌、牙龈癌”知识点。